某女，29岁。咳嗽2月余，干咳无痰，咽喉干痒，时有声音嘶哑。舌红少苔，脉细数。根据辨证结果，应采取的治法是
A. 滋阴润肺
B. 补气益肺
C. 辛凉清润
D. 宣肺散寒
E. 清肝滋肺

正确答案：A。滋阴润肺

解析：本题考查的是咳嗽的辨证论治。咳嗽2月余，干咳无痰，咽喉干痒，时有声音嘶哑。舌红少苔，脉细数。根据辨证结果，应采取的治法是滋阴润肺（A对）。咳嗽是指肺失宣降，肺气上逆作声，或伴咳吐痰液，为肺系疾病的主要表现之一。西医学中急慢性支气管炎、部分支气管扩张症、慢性咽炎、咳嗽变异性哮喘等以咳嗽为主要表现时，可参考此内容辨证论治。（一）风寒袭肺证：【症状】咳嗽声重，气急，咽痒，咳痰稀薄色白，常伴鼻塞，流清涕，头痛，肢体酸楚，或见恶寒、发热、无汗等风寒表证。舌苔薄白，脉浮或浮紧。【治法】疏风散寒，宣肺（D错）止咳。（二）风热犯肺证：【症状】咳嗽频剧，气粗，或咳声嗄哑，咳痰不爽，痰黏稠或稠黄，喉燥咽痛，口渴，鼻流黄涕，头痛，肢楚，恶风身热。舌边尖红，苔薄黄，脉浮数。【治法】疏风清热，宣肺止咳。（三）风燥伤肺证：【症状】干咳，连声作呛，咽痒，咽喉干痛，唇鼻干燥，口干，无痰或痰少而黏，不易咳出，或痰中带血丝，初起或伴鼻塞、头痛、微寒、身热。舌质红而少津，苔薄白或薄黄，脉浮数。【治法】疏风清肺，润燥止咳。（四）痰湿蕴肺证：【症状】咳嗽反复发作，咳声重浊，痰黏腻，或稠厚成块，痰多易咳，早晨或食后咳甚痰多，进甘甜油腻物加重，胸闷脘痞，呕恶，食少，体倦，大便时溏。舌苔白腻，脉滑。【治法】健脾燥湿，化痰止咳。（五）痰热郁肺证：【症状】咳嗽，气息粗促，或喉中有痰声，痰多，质黏稠色黄，或有腥味，难咳，胸胁胀满，或咳时引痛，面赤，或有身热，口干而黏，欲饮水。舌红，苔黄腻，脉滑数。【治法】清热肃肺，豁痰止咳。（六）肺阴亏耗证：【症状】咳嗽日久，干咳少痰，或痰中带血，午后咳甚，或伴五心烦热，颧红，耳鸣，消瘦，神疲。舌质红，苔少，脉细数。【治法】滋阴润肺，止咳化痰。通过补脾益气而补益肺气（B错）的治法，即培土生金法，又称补养脾肺法。适用于脾胃气虚，生化减少，而致肺气失养的肺脾气虚证。临床可见久咳，痰多清稀，食欲减退，大便溏薄，四肢无力，舌淡脉弱等症。滋肺阴、清肝（E错）火的治法，即佐金平木法，又称滋肺清肝法，适用于肺阴不足、肝火上逆犯肺之证。治法为辛凉清润（C错）的病证，2022年考试指南未明确说明。